下列哪项不属于公共场所的卫生项目
A. 空气
B. 湿度
C. 温度
D. 气压
E. 风速

正确答案：D。气压